氟牙症的病理变化是
A. 牙本质矿化不良
B. 牙釉质矿化不良
C. 牙本质表面矿化不足
D. 牙釉质表面矿化不足
E. 釉牙本质界弧形结构模糊

正确答案：B。牙釉质矿化不良

解析：氟牙症，又称斑釉牙、氟斑牙。在牙齿发育阶段，如果饮用水中氟含量高于百万分之一（1ppm），或经其他途径摄入过多的氟，氟离子可导致釉质形成不全和钙化不全，形态学上表现为表层钙化良好，其深方的表层下区存在弥漫性的矿化不良。掌握“氟牙症、先天性梅毒牙与牙本质形成缺陷”知识点。